某患者因上感而就医，进行青霉素过敏试验中致死
A. 效应
B. 反应
C. 剂量-效应（反应）关系
D. 有的个体不遵循剂量（效应）反应关系规律

正确答案：D。有的个体不遵循剂量（效应）反应关系规律

解析：本题考查剂量-反应（效应）关系规律。剂量-反应（效应）关系是指外源化学物作用于生物体的剂量与引起的生物学改变的发生率或作用强度之间的相互关系。通常，随着剂量的增加，外源化学物导致的某种生物学作用的发生率或作用强度也随之增加或减少。某患者因上感而就医，进行青霉素过敏试验中致死说明有的个体不遵循剂量（效应）反应关系规律（D对ABC错）。